下列哪项检查最有助于该患儿的确诊
A. 心脏彩色多普勒超声检查
B. 脑电图
C. 胸部平片
D. 自身抗体的检测
E. 心电图

正确答案：A。心脏彩色多普勒超声检查

解析：如5项临床表现中不足4项，但超声心动图有冠状动脉损害，亦可确诊为川崎病。掌握“川崎病”知识点。